下列哪项可判断为早期胃癌
A. 病灶局限于胃肌肉层
B. 病灶局限于黏膜或黏膜下层
C. 无淋巴结转移
D. 直径小于1cm
E. 病灶局限于胃小弯

正确答案：B。病灶局限于黏膜或黏膜下层